患者，男，45岁，头痛经久不愈，痛处固定不移，刺痛。舌质紫暗，脉涩。治疗应首选
A. 川芎茶调散
B. 芎芷石膏汤
C. 龙胆泻肝汤
D. 通窍活血汤
E. 天麻钩藤饮

正确答案：D。通窍活血汤

解析：题中患者头痛经久不愈，诊断为头痛。刺痛，舌质紫暗，脉涩为瘀血阻窍，络脉滞涩所致，是瘀血证的表现，治宜活血化瘀，通窍止痛，代表方为通窍活血汤（D对）。川芎茶调散为风寒头痛的代表方（A错）。芎芷石膏汤为风热头痛的代表方（B错）。龙胆泻肝汤用于治疗肝胆实火上扰证（C错）。天麻钩藤饮为肝阳头痛的代表方（E错）。